长期服用氯丙嗪后，并使用抗胆碱药使症状加重的出现的症状是
A. 帕金森综合症
B. 静坐不能
C. 急性肌张力障碍
D. 体位性低血压
E. 迟发性运动障碍

正确答案：E。迟发性运动障碍

解析：长期服用氯丙嗪后，部分患者还可引起迟发性运动障碍，表现为口-面部不自主的刻板运动，广泛性舞蹈样手足徐动症，停药后仍长期不消失。用抗胆碱药反使症状加重。掌握“氯丙嗪”知识点。